属于医师违背尊重原则的是
A. 医师检查患者时，由于消毒观念不强，造成交叉感染
B. 医师满足患者的一切保密要求
C. 妊娠危及母亲的生命时，医师给予引产
D. 医师对患者的呼叫或提问给予应答
E. 医师的行为使某个患者受益，但却损害了别的患者的利益

正确答案：B。医师满足患者的一切保密要求